前列腺癌确诊的方法是
A. 直肠指检
B. 前列腺穿刺
C. MRI
D. CT检查
E. PSA检查

正确答案：B。前列腺穿刺